劳动卫生学是研究劳动条件对（）健康影响的学科
A. 工人
B. 农民
C. 体力劳动者
D. 劳动者
E. 脑力劳动者

正确答案：D。劳动者

解析：本题考查劳动卫生学的研究内容。职业卫生学以前称劳动卫生学，是以职业人群为主要对象，主要研究劳动条件对职业人群健康的影响，主要任务是识别、评价、预测、控制和研究不良劳动条件，为保护职业从事者健康、提高作业能力、改善劳动条件所应采取的措施提供科学依据。无论是体力劳动者、脑力劳动者、工人还是农民，均属于劳动者的范畴。因此，劳动卫生学是研究劳动条件对劳动者（D对ABCE错）的健康影响的学科。